干酪性肺炎的条件
A. 遗传性因索
B. 结核杆菌
C. 营养缺乏
D. 代谢因素
E. 食道静脉曲张破裂出血

正确答案：C。营养缺乏

解析：干酪性肺炎又称结核性大叶性肺炎，属于浸润性肺结核，营养缺乏（C对）是机体抵抗力降低，又是肺结核发生的重要条件之一。